固定酸的调节主要通过
A. 肝脏
B. 肾脏
C. 肺脏
D. 骨骼
E. 心脏

正确答案：B。肾脏

解析：固定酸的调节主要通过肾脏（B对）。挥发酸的调节主要通过肺脏（C错）